女性，32岁。患者神经衰弱3月余，未经治疗，主要表现头痛，失眠，脑力疲乏，精神易兴奋，应选择下列哪种药物进行治疗
A. 地西泮
B. 氯氮平
C. 利培酮
D. 喹硫平
E. 氯丙嗪

正确答案：A。地西泮

解析：地西泮是苯二氮䓬类，其具有抗焦虑、镇静催眠、抗惊厥和癫痫作用，可有效缓解该患者的神经衰弱、失眠，脑力疲乏、精神易兴奋，并且依赖性和戒断症状较轻，所以该患者选用地西泮治疗效果好（A对）。氯氮平、利培酮、喹硫平、氯丙嗪均属于抗精神病药物，无缓解神经衰弱和失眠的作用（BCDE错）。